临床上不易查出的继发龋可用下列哪些方法帮助诊断
A. 探诊
B. X线
C. 染色法
D. 麻醉法
E. 温度测验

正确答案：B。X线

解析：本题考查龋病的诊断及鉴别诊断。继发龋X线片（B对）可见修复体与洞壁、洞底之间存在透射影。